某女，45岁。患月经不调、带下病。症见月经先后不定期、量多、色淡无块，带下量多、色白清稀、神疲乏力、腰膝酸软。内服宜选用的成药是
A. 妇科十味片
B. 妇炎平胶囊
C. 白带丸
D. 千金止带丸
E. 女金丸

正确答案：D。千金止带丸

解析：本题考查的是千金止带丸的主治。患月经不调、带下病。症见月经先后不定期、量多、色淡无块，带下量多、色白清稀、神疲乏力、腰膝酸软。内服宜选用的成药是千金止带丸（D对）。千金止带丸：【主治】脾肾两虚所致的月经不调、带下病，症见月经先后不定期、量多或淋沥不净、色淡无块，或带下量多、色白清稀、神疲乏力、腰膝酸软。妇科十味片（A错）：【主治】血虚肝郁所致的月经不调、痛经、月经前后诸证，症见行经后错，经水量少、有血块，行经小腹疼痛，血块排出痛减，经前双乳胀痛、烦躁，食欲不振。妇炎平胶囊（B错）：【主治】湿热下注所致的带下病、阴痒，症见带下量多、色黄味臭、阴部瘙痒；滴虫、霉菌、细菌引起的阴道炎、外阴炎见上述证候者。白带丸（C错）：【主治】湿热下注所致的带下病，症见带下量多、色黄、有味。女金丸（E错）：【主治】气血两虚、气滞血瘀所致的月经不调，症见月经提前、月经错后、月经量多、神疲乏力、经水淋漓不净、行经腹痛。